月经先后不定期的主要发病机制是
A. 肝郁气滞，疏泄失调
B. 皆气不足，封藏失职
C. 脾气虚弱，统摄无权
D. 湿热下注，任带不固
E. 气血失调，血海蓄溢失常

正确答案：E。气血失调，血海蓄溢失常

解析：月经先后不定期的发病机制是肝肾功能失常，冲任失调，血海蓄溢无常（E对），病因多为肝郁和肾虚。肝藏血，司血海，主疏泄，肝气条达，血海按时充盈，则月经周期正常。疏泄太过则月经先期而至，疏泄不及则月经后期而来，遂致月经先后无定期。肾为先天之精，主封藏；肾又主施泄，若素体肾气不足或多产房劳，大病久病伤肾等致肾气亏损，藏泄失司，冲任失调，血海蓄溢失常。若当藏不藏则月经先期而至，当泄不泄则月经后期而来。